pKa为4.2的有机酸（苯甲酸）在消化道中吸收最好的部位是
A. 胃
B. 十二指肠
C. 小肠
D. 结肠

正确答案：A。胃

解析：本题考查pKa为4.2的有机酸（苯甲酸）在消化道中吸收最好的部位。pKa为4.2的有机酸（苯甲酸）主要呈非解离状态，脂溶性高，在消化道中吸收最好的部位是胃（A对BCD错）。